湿热熏蒸的面色是
A. 黄而鲜明
B. 黄如烟熏
C. 苍黄
D. 淡黄消痩
E. 淡黄浮肿

正确答案：A。黄而鲜明

解析：湿热蕴蒸肝胆，胆热外泄，外渗肌肤，下流膀胱，而致一身面目及小便尽黄。证见发热烦渴，身目黄色鲜明如橘子色，小便色深如浓茶，伴食欲减退或恶心呕吐，大便不畅等。（A对）。黄而晦暗如烟熏者（B错），称为阴黄，多因寒湿困阻而成。面色青黄，即面色青黄相兼，又称苍黄（C错）者，多属肝郁脾虚、血瘀水停，可见于鼓胀或胁下癥积的患者。脾胃虚衰，无以运化水谷精微，气血化生无源，机体失养，故面色淡黄消痩（D错），枯槁无华。面色黄而浮肿（E错）者，称为黄胖，属脾虚湿蕴。因脾失健运，水湿内停，泛溢肌肤所致。